男，66岁，双手震颤，行动迟缓一年，查体，面具脸，静止时手有搓丸样震颤，手臂齿轮样强直，迈步前动作迟缓，能改善其症状的药物作用机制是升高脑内
A. 多巴胺水平
B. 去甲肾上腺素水平
C. GABA水平
D. 乙酰胆碱水平
E. 5-HT水平

正确答案：A。多巴胺水平

解析：患者男，66岁，双手震颤，行动迟缓一年，查体，面具脸，静止时手有搓丸样震颤，手臂齿轮样强直，迈步前动作迟缓，结合患者的表现，提示为帕金森病，它的主要病理改变为黑质多巴胺（DA) 能神经元变性死亡（A对）。